开具的处方须经所在执业地点执业医师签字或加盖专用签章后方有效的是
A. 试用期的医师
B. 实习医师
C. 见习医师
D. 经注册的执业医师
E. 经注册的执业助理医师

正确答案：E。经注册的执业助理医师

解析：开具的处方须经所在执业地点执业医师签字或加盖专用签章后方有效的是经注册的执业助理医师（E对）。经注册的执业医师具有在执业地点取得相应处方权（D错）。试用期的医师（A错）、实习医师（B错）、见习医师（C错）不具备处方权。